药物不良反应多有自限性特点，停药后
A. 进行洗胃
B. 进行透析
C. 同时禁食
D. 无须特殊处理
E. 采取对症治疗

正确答案：D。无须特殊处理